女，31岁，初孕妇。妊娠34周。查体：T36.5℃，P90次/分，R18次/分，BP120/80mmHg。叩诊心浊音界稍向左扩大，心尖部闻及2/6级收缩期吹风样杂音。踝部轻度水肿。最可能的诊断是
A. 围生期心肌病
B. 妊娠期高血压疾病性心脏病
C. 原发性心肌病合并妊娠
D. 风湿性心脏病合并妊娠
E. 正常妊娠改变

正确答案：E。正常妊娠改变

解析：女，31岁，初孕妇。妊娠34周。查体：T36.5℃，P90次/分，R18次/分，RP120/80mmHg。叩诊心浊音界稍向左扩大，心尖部闻及2/6级收缩期吹风样杂音（属于妊娠期心脏正常变化）。踝部轻度水肿（是由于妊娠期下肢静脉压显著升高，加之增大子宫压迫下腔静脉而导致）。综合该患者的病史、体征，该患者诊断考虑为正常妊娠改变（E对）。围生期心肌病（A错）是指既往无心血管疾病史的孕妇在妊娠晚期至产后6个月内发生的扩张性心肌病，表现为心肌收缩功能障碍和充血性心力衰竭，而该孕妇无呼吸困难、心悸、咳嗽、咯血、端坐呼吸、胸痛、肝大、水肿等心力衰竭症状。该初孕妇血压正常，不考虑妊娠期高血压疾病性心脏病（B错）。该初孕妇妊娠前无风湿性心脏病及心脏病的病史，所以不考虑心脏病合并妊娠（C错）及风湿性心脏病合并妊娠，性质待查（D错）。